初戴全口义齿时，发现总义齿左右翘动，加力时患者有痛感。可能引起翘动的原因中不包括
A. 基托伸展过长
B. 印模不准确
C. 进入倒凹区基托未缓冲
D. 基托变形
E. 与硬区相应的基托组织面未做缓冲

正确答案：C。进入倒凹区基托未缓冲

解析：本题考查义齿翘动的原因。初戴全口义齿时，发现下总义齿左右翘动，加力时患者有痛感。可能引起翘动的原因中不包括进入倒凹区基托未缓冲（C错，为本题的正确答案）。模型预备时，倒凹区填的石膏不足，使基托进入倒凹区过多，义齿戴入困难。基托伸展过长（A对），会受唇颊舌肌的影响，发生翘动。印模不准确（B对）与基托变形（D对）可能会使基托形成高点，造成翘动。基托组织面未做缓冲（E对），可能存在尖锐的突起或塑料小瘤子，与硬区接触时，引起翘动。